脑膜中动脉的血液来源于
A. 大脑前动脉
B. 大脑后动脉
C. 基底动脉
D. 颈内动脉
E. 颈外动脉

正确答案：E。颈外动脉

解析：脑膜中动脉的血液来源于颈外动脉（E对）。颈内动脉（D错）的分支包括大脑前动脉（A错）、大脑中动脉、脉络丛前动脉、后交通动脉。基底动脉（C错）的分支包括小脑下前动脉、迷路动脉、脑桥动脉、小脑上动脉、大脑后动脉（B错）。